患者，女，17岁，主诉咬苹果时苹果上有血迹，检查见前牙区唇侧龈乳头圆钝、深红色。探诊深度4mm，未探及附着丧失。该患者最可能的诊断是
A. 急性龈乳头炎
B. 青少年牙周炎
C. 慢性牙周炎
D. 青春期龈炎
E. 慢性龈缘炎

正确答案：D。青春期龈炎

解析：本题考查青春期龈炎的诊断。患者女，17岁（青春期），主诉咬苹果时苹果上有血迹（咬硬物出血），检查见前牙区唇侧龈乳头圆钝（肿胀、球状突起）、深红色。探诊深度4mm，未探及附着丧失（非牙周炎）。上述症状，该患者最可能的诊断是青春期龈炎（D对）。青春期少年体内性激素水平的变化，是青春期龈炎发生的全身因素，青春期龈炎好发于前牙唇侧的龈乳头和龈缘，舌侧牙龈较少发生。急性龈乳头炎（A错）主要是由于受到机械或者是化学刺激而引起的牙龈乳头发炎，牙间乳头充血、肿胀，探触和吸吮时易出血，可有自发胀痛或探触痛。青少年牙周炎（B错）指发生在青少年时期的一种特殊类型的牙周炎，可出现牙齿的松动、移位，特别是上颌切牙和第一磨牙更为明显，严重时上颌前牙呈扇形展开，临床附着丧失。慢性牙周炎（C错）一般侵犯全口多数牙齿，也有少数患者仅发生于一组牙或少数牙，牙龈呈现不同程度的慢性炎症，颜色暗红或鲜红，质地松软，点彩消失，边缘圆钝且不与牙面贴附，临床附着丧失。慢性龈缘炎（E错）由局部刺激性因素所引起，如菌斑、牙石、食物嵌塞和不良修复体等，龈乳头变为深红或暗红色、圆钝肥大、表面光滑发亮、松软脆弱、缺乏弹性。